典型的食管癌症状特点是
A. 持续性胸骨后异物感
B. 渐进加重的吞咽困难
C. 间断吞咽困难伴呕吐
D. 胸痛
E. 反酸、烧心伴吞咽困难

正确答案：B。渐进加重的吞咽困难

解析：典型的食管癌症状特点是渐进性加重的吞咽困难（B对），先是难咽干的食物，继而半流质，最后水和唾液也不能咽下。持续性胸骨后异物感（A错）为早期食管癌的一般表现，无特异性。间断吞咽困难伴呕吐（C错）为贲门失弛缓症的典型表现。胸痛（D错）可见于食管癌晚期侵犯食管外组织的患者，还可见于多种胸部疾病，无特异性。反酸、烧心伴吞咽困难（E错）为胃食管反流病的典型表现。